下列关于分泌管的论述中不正确的一项是
A. 与闰管相延续
B. 又可称为纹管
C. 胞质丰富，呈强嗜碱性
D. 核圆形，位于细胞中央或近基底部
E. 管径较粗，管壁由单层柱状上皮所组成

正确答案：C。胞质丰富，呈强嗜碱性

解析：分泌管与闰管相延续（A对）。管径较粗，管壁由单层柱状上皮所组成（E对）。核圆形，位于细胞中央或近基底部（D对）。胞质丰富，呈强嗜酸（C错）性。在基底部有垂直于基底面的纵纹，所以分泌管又称纹管（B对）。上皮细胞能主动吸收Na+、排出K+和HCO3-，并转运水，改变原始唾液量并使分泌物低渗。此功能受肾上腺皮质分泌的醛固酮等激素的调节，而细胞底部的折叠与密集的线粒体则起“钠泵”作用。